外耳道
A. 是从外耳门至内耳门的管道
B. 外侧2/3为软骨部
C. 婴儿外耳道长而直
D. 外耳道前壁和下壁较后壁和上壁长
E. 无

正确答案：D。外耳道前壁和下壁较后壁和上壁长

解析：外耳道是从外耳门至鼓膜的管道（A错）。外耳道外侧1/3 为软骨部（B错）。婴儿外耳道短而直（C错）。故本题正确答案为外耳道前壁和下壁较后壁和上壁长（D对），此选项9版教材未明确。